冶疗昏迷，高热，应首选
A. 四缝
B. 曲池
C. 八邪
D. 合谷
E. 十宣

正确答案：E。十宣

解析：十宣（E对）主治昏迷、癫痫、高热、咽喉肿痛，手指麻木。四缝（A错）主治小儿疳积、百日咳。曲池（B错）主治上肢病证热病、眩晕、肠胃病证、五官热性病证、皮外科疾患、癫狂。八邪（C错）主治手背肿痛、手指麻木；烦热、目痛；毒蛇咬伤。合谷（D错）主治头面五官诸疾、外感病证、热病无汗或多汗、妇产科病证；针麻。